对细菌性痢疾来说哪项是对的
A. 潜伏期1～2天
B. 近年来在临床上很少见
C. 粪便中有大量单核细胞
D. 通常结肠与小肠均有炎症
E. 治疗菌痢，首选氯霉素

正确答案：A。潜伏期1～2天

解析：B选项：多见。C选项：镜检有大量脓细胞、红细胞与巨噬细胞。D选项：细菌性痢疾病变部位主要发生于大肠,尤以乙状结肠和直肠为重。E选项：首选喹诺酮类。掌握“细菌性痢疾”知识点。